静脉血回流因素有
A. 静脉瓣是促进静脉回流的重要装置
B. 静脉周围的肌肉活动有助于血液向心流动
C. 心房的舒张与吸气活动能吸引头颈胸部静脉血回心
D. 各伴行静脉受同一血管鞘内动脉搏动影响
E. 以上描述全对

正确答案：E。以上描述全对

解析：静脉瓣是保证静脉回流的重要装置，静脉周围的肌肉活动有助于血液向心流动，心房的舒张与吸气活动能吸引头颈胸部静脉血回心，各伴行静脉受同一血管鞘内动脉搏动影响（ABCD对，故E为本题正确答案）。